内斜线是以下哪项肌肉的起点
A. 颏舌肌
B. 颏舌骨肌
C. 下颌舌骨肌
D. 降口角肌
E. 降下唇肌

正确答案：C。下颌舌骨肌

解析：自下颏棘斜向后上与外斜线相应的骨嵴称为内斜线（下颌舌骨线），为下颌舌骨肌起点。掌握“下颌骨及腭骨解剖特点”知识点。